蒙医中的“三秽”指的是
A. 涕、唾、津三种分泌物
B. 血、脂、白精三种物质
C. 稠、稀、汗三种排泄物
D. 汗、尿、大便三种排泄物
E. 赫依、希日、巴达干三物质

正确答案：C。稠、稀、汗三种排泄物

解析：本题考查的是蒙医中的“三秽”。蒙医中的“三秽”指的是稠、稀、汗等三种排泄物（C对）。三秽：稠、稀、汗等三种排泄物，是七素生化过程中的产物，对诊治疾病有重要参照意义。血、脂、白精三种物质（B错）属于七素。七素：又称七精。分别为精华、血、肉、脂、骨、髓及红或白精，是机体的构成物质。赫依、希日、巴达干三物质（E错）为三根。三根：“赫依”“希日”“巴达干”为三根，是人体的本基。蒙医用三根的动态关系来解释人体的生理、病理现象。涕、唾、津三种分泌物（A错）与汗、尿、大便三种排泄物（D错），2022年考试指南未明确说明。